女，38岁。发热、皮疹、脱发和口腔溃疡6个月。查体：T39.0℃，面部有充血性红斑，双手近端指间关节压痛，轻度肿胀，双下肢凹陷性水肿。实验室检查：尿蛋白（+++），尿红细胞（+++），24小时尿蛋白3.8g，血PIt88×10⁹/L，ANA1：640，抗SSA抗体（+），抗双链DNA抗体（+），补体C3低下。不能提示患者疾病处于活动期的指标是
A. 补体C3低下
B. 尿蛋白（+++）
C. 抗双链DNA抗体（+）
D. 血小板减少
E. 抗SSA（+）

正确答案：E。抗SSA（+）

解析：患者青年女性（系统性红斑狼疮好发人群），有发热、皮疹、脱发和口腔溃疡，面部可见充血性红斑，双手近端指间关节压痛，轻度肿胀，双下肢凹陷性水肿，实验室检查：尿蛋白（+++），尿红细胞（+++），尿蛋白3.8g/d（提示有大量蛋白尿），血Plt88×10⁹/L（正常值100～300×10⁹/L，减少），ANA1：640（提示抗核抗体阳性），抗SSA抗体（+），抗双链DNA抗体（+），补体C3低下，综合患者的临床表现、查体和实验室检查，考虑诊断为系统性红斑狼疮。能提示系统性红斑狼疮（SLE）处于活动期的指标是补体C3低下（A对）、尿蛋白（+++）（B对）、抗双链DNA抗体（+）（C对）、血小板减少（D对）。需要注意的是P818指出血小板计数增多能提示疾病处于活动期的观点是错误的。抗SSA（+）（P817）（E错，为本题正确答案）与SLE中出现光过敏、血管炎、皮损、白细胞减低、平滑肌受累、新生儿狼疮等相关，并非提示患者疾病处于活动期的指标。